《中国药典》一部中，用甲苯法测定水分的药材
A. 木香
B. 砂仁
C. 甘草
D. 木通
E. 肉桂

正确答案：A、B、E。木香；砂仁；肉桂

解析：本题考查的是甲苯法测定水分的药材。《中国药典》一部中，用甲苯法测定水分的药材木香（A对）、砂仁（B对）、肉桂（E对）。《中国药典》规定水分测定法有五种：第一法（费休氏法）包括容量滴定法和库仑滴定法。第二法（烘干法）适用于不含和少含挥发性成分的药品，如三七、广枣等。第三法（减压干燥法）适用于含挥发性成分的贵重药品，如厚朴花、蜂胶等。第四法（甲苯法）适用于含挥发性成分的药品，如肉桂、肉豆蔻、砂仁等。第五法（气相色谱法），如辛夷。